高动力型休克可见于
A. 失血性休克
B. 创伤性休克
C. 过敏性休克
D. 心源休克
E. 感染性休克

正确答案：E。感染性休克

解析：感染性休克（E对）即脓毒性休克，按其血流动力学变化可分为高动力型休克和低动力型休克，高动力型休克指病原体或其毒素侵入机体后，引起高代谢和高动力循环状态，即出现发热、心排出益增加、外周阻力降低、脉压增大等临床特点，又称为高排低阻型休克或暖休克。失血性休克（A错）、创伤性休克（B错）和过敏性休克（C错）无分型。心源性休克（D错）根据血流动力学的变化可分为两型，低排高阻型和低排低阻型，低排高阻型休克即低动力型休克：大多数患者表现为外周阻力增高，与血压下降，减压反射受抑而引起交感－肾上腺髓质系统兴奋和外周小动脉收缩有关。